根据《中华人民共和国行政处罚法》，对当审人不予行政处罚的情形是
A. 受他人胁迫有违法行为的
B. 主动消除或者减轻违法行为危害后果的
C. 配合行政机关查处违法行为有立功表现的
D. 违法行为在两年后才被发现，法律未另行规定的
E. 间歇性精神病人在精神正常时有违法行为的

正确答案：D。违法行为在两年后才被发现，法律未另行规定的

解析：本题考查的是行政处罚的适用。根据《中华人民共和国行政处罚法》，对当审人不予行政处罚的情形是违法行为在两年后才被发现，法律未另行规定的（D对）。行政处罚的适用：适用条件：必须已经实施了违法行为，且该违法行为违反了行政法规范；行政相对人具有责任能力；行政相对人的行为依法应当受到处罚；违法行为未超过追究时效。适用方式分为：（1）不予处罚：①不满十四周岁的人有违法行为的，不予行政处罚；②违法行为在两年内未被发现的，除法律另有规定外，不再给予行政处罚；③精神病人在不能辨认或者控制自己行为时有违法行为的，不予行政处罚（E错）；④如违法行为轻微并及时纠正，没有造成危害后果的，不予行政处罚。（2）从轻或者减轻处罚：受行政处罚的当事人有下列情形之一的，应当依法从轻或者减轻行政处罚：①主动消除或者减轻违法行为危害后果的（B错）；②受他人胁迫有违法行为的（A错）；③配合行政机关查处违法行为有立功表现的（C错）；④已满十四周岁不满十八周岁的人有违法行为的。